女，30岁。化脓性阑尾炎术后一周，切口红肿硬结，但拆线后未见脓性分泌物，切口愈合类型应记为
A. Ⅱ／丙
B. Ⅲ／甲
C. Ⅱ／乙
D. Ⅲ／乙
E. Ⅲ／丙

正确答案：D。Ⅲ／乙

解析：患者化脓性阑尾炎术后，切口红肿硬结，但未见脓性分泌物，切口愈合类型应记“Ⅲ/乙”（D对）。对于初期完全缝合的切口，拆线时应记录切口愈合情况，可分为三类：①清洁切口（Ⅰ类切口），指缝合的无菌切口，如甲状腺大部切除术等。②可能污染的切口（Ⅱ类切口）指手术时可能带有污染的缝合切口，如胃大部切除术等。皮肤不容易彻底消毒的部位、6小时内的伤口经过清创缝合、新缝合的切口再度切开者，也属于此类（AC错）。③污染切口（Ⅲ类切口）指临近污染区或组织直接暴露于污染或感染物的切口，如阑尾穿孔的阑尾切除术、肠梗阻坏死肠管切除手术等。切口愈合也分为三级：①甲级愈合，用“甲”字代表，指愈合优良，无不良反应（B错）。②乙级愈合，用“乙”字代表，指愈合处有炎症反应，如红肿、硬结、血肿、积液等，但未化脓。③丙级愈合，用“丙”字代表，指切口化脓，需要做切开引流等处理（E错）。